治疗痿证肝肾亏损髓枯筋痿证，应首选的方剂是
A. 一贯煎
B. 大补阴煎
C. 右归饮
D. 金匮肾气丸
E. 大补元煎

正确答案：B。大补阴煎

解析：所以治疗痿证肝肾亏损，髓枯筋痿证应首选的方剂是大补阴煎（B对）。一贯煎的主要功效是治疗肝阴虚（A错）。右归饮和金贵肾气丸主要是温补肾阳（CD错）。大补元煎的主要功效是救本培元，大补气血（E错）。